下列妊娠期急性肾盂肾炎的治疗，错误的是
A. 首选氨苄西林、头孢菌素类药物
B. 无症状性菌尿2周为1疗程
C. 有症状性肾盂肾炎4周为1疗程
D. 症状重者两药联合静滴效果佳
E. 选用喹诺酮类药物

正确答案：E。选用喹诺酮类药物

解析：妊娠期急性肾盂肾炎的治疗：抗生素首选对胎儿影响较小的药物，如氨苄西林、青霉素类、头孢菌素类（A对）。若为无症状菌尿症和急性膀胱炎，以2周为1疗程（B对）。若为有症状性肾盂肾炎，则4周为1疗程（C对）。其他抗生素可根据药敏结果选用，症状重者两药联合静滴效果佳（D对）（E错，为本题正确答案）。